适应证仅用于治疗失眠的药物是
A. 地西泮
B. 佐匹克隆
C. 苯巴比妥
D. 氟西汀
E. 咪达唑仑

正确答案：B。佐匹克隆

解析：本题考查镇静催眠药的作用。佐匹克隆（B对）仅用于治疗失眠；地西泮（A错）可用于镇静催眠、抗焦虑、抗癫痫和抗惊厥；苯巴比妥（C错）可用于治疗焦虑、失眠、癫痫及运动障碍；氟西汀（D错）为较强的抗抑郁药；咪达唑仑（E错）可治疗失眠症，还可用于外科手术或诊断检查时作诱导睡眠用。